以下哪种间隙感染可出现呼吸道阻塞及全身中毒症状
A. 咬肌间隙感染
B. 翼下颌间隙感染
C. 口底多间隙感染
D. 下颌下间隙感染
E. 咽旁间隙感染

正确答案：C。口底多间隙感染

解析：口底蜂窝组织炎不论是化脓性病原菌引起的感染或腐败坏死性病原菌引起的感染，局部及全身症状均很严重。其主要危险是呼吸道的阻塞及全身中毒。掌握“口底多间隙感染”知识点。